某医生拔除患者上颌中切牙和侧切牙时，发现他在同样施用旋转的方式且施力的大小和速度基本一致的情况下，侧切牙的牙根尖三分之一折断在牙槽窝内，分析其原因最有可能的是
A. 侧切牙的牙根比中切牙的牙根更易折断
B. 侧切牙牙根尖1/3常有弯曲，施用旋转力拔除时较易折断
C. 拔除侧切牙时，旋转力施用不够
D. 与拔除中切牙和侧切牙的先后顺序有关
E. 以上都不是

正确答案：B。侧切牙牙根尖1/3常有弯曲，施用旋转力拔除时较易折断

解析：根据前牙牙根形态，上颌中切牙牙根圆直，拔除时可以用旋转力拔除，上颌侧切牙牙根可能有弯曲，牙拔除时应仔细。掌握“恒前牙、恒前磨牙的髓腔形态及应用解剖”知识点。